乳癖消胶囊是治疗乳癖、乳痈的常用成药，某外科医师经常使用。此因该成药除软坚散结外，又能
A. 理气化痰，清热解毒
B. 活血消痈，理气止痛
C. 疏肝理气，消肿止痛
D. 凉血消肿，化瘀止痛
E. 活血消痈，清热解毒

正确答案：E。活血消痈，清热解毒

解析：本题考查乳癖消胶囊的功能。此因该成药除软坚散结外，又能活血消痈，清热解毒（E对）。乳癖消胶囊（颗粒、片）【功能】软坚散结，活血消痈，清热解毒。硼砂【功效】外用清热解毒，内服清肺化痰（A错）。复方丹参片（丸、胶囊、滴丸）【功能】活血化瘀，理气止痛（B错）。柴胡舒肝丸【功用】疏肝理气，消胀止痛（C错）。宫血宁胶囊【功能】凉血止血，清热除湿，化瘀止痛（D错）。